凡是分子量小的（100～200）水溶性化合物通过生物膜的方式
A. 简单扩散
B. 滤过
C. 主动转运
D. 载体扩散
E. 胞饮和吞噬

正确答案：B。滤过

解析：本题考查化学毒物通过生物膜的方式。滤过是化学毒物通过生物膜上亲水性孔道的过程。凡是分子量小的（100～200）水溶性化合物通过生物膜的方式为滤过（B对ACDE错）。